正确描述尿道球腺的是
A. 为一对约豌豆大之扁平形小体
B. 位于会阴深隙内
C. 开口于尿道的尿道球部
D. 其分泌物参与构成精液
E. 上述全部正确

正确答案：E。上述全部正确

解析：尿道球腺是一对豌豆大的球形腺体。位于会阴深横肌内。开口于尿道球部。其分泌物参加精液的组成（ABCD对,故E为本题正确答案）。